标定高氯酸滴定液的基准物是
A. 醋酸钠
B. 氯化钠
C. 亚硝酸钠
D. 硫代硫酸钠
E. 邻苯二甲酸氢钾

正确答案：E。邻苯二甲酸氢钾

解析：本题考查常用溶液的配制和标定。标定氢氧化钠滴定液的基准物是邻苯二甲酸氢钾（E对）。用减重法精密称取在105℃～110℃干燥至恒重的基准物邻苯二甲酸氢钾3份，每份约0.5g，分别置于250ml锥形瓶中，各加纯化水50ml，使之完全溶解。加酚酞指示剂2滴，用待标定的NaOH溶液滴定至溶液呈淡红色，且30秒不褪色，即可。